患者，男，28岁。左下第三磨牙近中阻生，左下第二磨牙远中颈部深龋，患者自述左下后牙冷热刺激疼痛，刺激去除后，无其他不适，无自发性疼痛。该患者治疗的正确方法是
A. 拔除左下第三磨牙，治疗左下第二磨牙
B. 拔除左下第三磨牙，观察左下第二磨牙
C. 先治疗左下第二磨牙，后拔除左下第三磨牙
D. 单侧治疗左下第二磨牙
E. 以上均不正确

正确答案：A。拔除左下第三磨牙，治疗左下第二磨牙

解析：左下第三磨牙近中阻生，左下第二磨牙远中颈部深龋，阻生智齿引起邻牙牙体或者牙周病变者，符合下颌阻生第三磨牙拔除术的适应证，应拔除左下第三磨牙，左下第二磨牙远中颈部深龋应进行相应的治疗。掌握“阻生牙拔除术”知识点。